体现寒热并用、辛开苦降、消补兼施配伍特点的方剂是
A. 半夏泻心汤
B. 生姜泻心汤
C. 甘草泻心汤
D. 健脾丸
E. 枳实消痞丸

正确答案：A。半夏泻心汤

解析：该题考查半夏泻心汤的方解。半夏泻心汤方用半夏、干姜、黄芩、黄连四味药物，以寒热平调，辛开苦降，本方主治寒热错杂之痞证，寒热互结，缘于中虚失运，故用人参、大枣以补脾虚，为佐药。使药以甘草补脾和中而调诸药。综合全方寒热互用以和其阴阳，苦辛并进以调其升降，补泻兼施以顾其虚实，是本方的配伍特点（A对）。半夏泻心汤、生姜泻心汤、甘草泻心汤三方均能辛开苦降、寒热并调，但生姜泻心汤为半夏泻心汤减干姜二两加生姜而成，重用生姜，宣散水气而消痞满，重在消（B错）。甘草泻心汤为半夏泻心汤加重炙甘草用量而成，重用炙甘草调中补虚，重在补（C错）。健脾丸中补气健脾药与消食行气药同用，为消补兼施之剂，无寒热并用，辛开苦降的特点（D错）。枳实消痞丸为半夏泻心汤和枳术丸化裁而成，方中用药有消有补，有寒有热，为消补兼施、辛开苦降的配伍特点（E错）。